男性，18岁，自幼有哮喘，每年春季发作，用沙丁胺醇可缓解。今在公园春游时突感胸闷气急。体检：气管居中，两肺呼吸音对称，呼气延长，闻及哮鸣音，心率100次/分，律齐，应采取的措施是
A. 心电图检查
B. 胸部X线检查
C. 吸入糖皮质激素
D. 口服泼尼松
E. 静脉推注氨茶碱

正确答案：E。静脉推注氨茶碱